侵蚀性葡萄胎与绒毛膜癌最主要的区别点是
A. 阴道流血时间长短
B. 距葡萄胎排空后时间长短
C. 尿中HCG值高低
D. 子宫大小程度不同
E. 活组织镜下见有无绒毛结构

正确答案：E。活组织镜下见有无绒毛结构

解析：侵蚀性葡萄胎的病变特点为：水泡状绒毛侵入子宫肌层，间质高度疏松水肿，绒毛间质内血管消失，大量异型的滋养层细胞浸润。绒毛膜癌的病变特点为：癌细胞不形成绒毛和水泡状结构，肿瘤自身无间质血管，大量异型的滋养层细胞浸。两者最主要的区别点是活组织镜下有无绒毛结构（E对）。阴道流血时间长短（A错）、距葡萄胎排空后时间长短（B错）、尿中HCG（人绒毛膜促性腺激素）值高低（C错）和子宫大小程度不同（D错）也可用来协助区分侵蚀性葡萄胎与绒毛膜癌，但都不是最主要的区别点。